能够吞噬和清除病原微生物，并且其表面的补体受体和Fc受体可增强吞噬作用的细胞是
A. B细胞
B. T细胞
C. 单核-巨噬细胞
D. NK细胞
E. 骨髓细胞

正确答案：C。单核-巨噬细胞

解析：单核-巨噬细胞可吞噬和清除病原微生物，其表面的补体受体和Fc受体可增强其吞噬作用。掌握“NK细胞、抗原提呈及其他免疫细胞”知识点。